不属于固体分散技术和包合技术共有的特点是
A. 掩盖不良气味
B. 改善药物溶解度
C. 易发生老化现象
D. 液体药物固体化
E. 提高药物稳定性

正确答案：C。易发生老化现象

解析：本题考查包合技术的特点。不属于固体分散技术和包合技术共有的特点是易发生老化现象（C错，为本题正确答案）。包合技术的特点：①增加药物溶解度和生物利用度；②掩盖药物不良气味，降低药物的刺激性；③减少挥发性成分的挥发损失，并使液体药物粉末化；④对易受热、湿、光照影响的药物，包合后可提高稳定性。固体分散体的特点：①可将难溶性药物高度分散于固体载体中；②延缓药物的水解和氧化，掩盖药物的不良气味和刺激性，使液态药物固体化；③当采用水溶性载体时，难溶性药物以分子状态分散在水溶性载体中，可加快药物的溶出，提高药物的生物利用度；④采用难溶性载体可达到缓释作用改善药物的生物利用度；⑤采用肠溶性载体可以控制药物仅在肠中释放；⑥固体分散体不稳定，久贮发生老化现象：物理稳定性差，属于高能不稳定态，高度分散的药物可能自发的聚集。